原发性肾小球疾病的病理分型不包括
A. 轻微性肾小球病变
B. 局灶性节段性病变
C. 肾病综合征
D. 膜性肾病
E. 增生性肾炎

正确答案：C。肾病综合征